右肾绞痛伴有镜下血尿，进一步检查应先进行
A. 膀胱镜
B. 腹部平片
C. 尿脱落细胞检查
D. CT
E. 中段尿培养

正确答案：B。腹部平片

解析：肾绞痛是输尿管结石的典型临床表现，诊断输尿管结石的首选影像学检查为超声，其次为腹部平片（B对）。膀胱镜（A错）主要用于膀胱结石的诊断。尿脱落细胞检查（C错）主要用于泌尿系肿瘤的筛查。CT（D错）价格昂贵，一般不作为结石的首选检查。中段尿培养（P534）（E错）主要用于泌尿系统感染的诊断。